按《中国药典》规定含量测定的指标成分为小檗碱的中药是
A. 艾叶
B. 五味子
C. 黄芩
D. 黄连
E. 葛根

正确答案：D。黄连

解析：本题考查的是黄连的主要化学成分。按《中国药典》规定含量测定的指标成分为小檗碱的中药是黄连（D对）。黄连的有效成分主要是生物碱，已经分离出来的生物碱有小檗碱（含量最高）、巴马汀、黄连碱、甲基黄连碱、药根碱和木兰碱（属于阿朴菲型）等；大多属苄基异喹啉类衍生物，季铵型生物碱。《中国药典》以小檗碱为指标成分进行含量测定。以盐酸小檗碱计，要求味连含小檗碱不得少于5.5%，表小檗碱不得少于0.80%，黄连碱不得少于1.6%，巴马汀不得少于1.5%；要求雅连含小檗碱不得少于4.5%；要求云连含小檗碱不得少于7.0%。艾叶（A错）的化学成分主要有挥发油、黄酮和三萜类成分。其中艾叶含挥发油0.45%～1.00%，《中国药典》以桉油精（桉叶素）和龙脑为指标成分，采用气相色谱法进行含量测定，要求桉油精不得少于0.050%，含龙脑不得少于0.020%。艾叶挥发油主要包括单萜类化合物、单萜类衍生物、倍半萜类化合物及其衍生物，其中30种单萜类衍生物占挥发油的79.20%，是艾叶挥发油的主要组成部分，包括1,8-桉树脑、茨烯、香桧烯、1-辛烯-3-醇、樟脑、α-松油醇、丁香酚等。五味子（B错）中含木脂素较多，约为5%，近年来从其果实中分得了一系列联苯环辛烯型木脂素。《中国药典》采用高效液相色谱法测定药材中五味子醇甲的含量，要求不得少于0.40%。黄芩（C错）中主要成分及其化学结构：从黄芩中分离出来的黄酮类化合物有黄芩苷（含4.0%～5.2%）、黄芩素、汉黄芩苷、汉黄芩素等20种成分。其中黄芩苷是主要有效成分，具有抗菌、消炎作用。《中国药典》以黄芩苷为指标成分进行含量测定要求药材含量不得少于9.0%，饮片含量不得少于8.0%。葛根（E错）含异黄酮类化合物，主要成分有大豆素、大豆苷、大豆素-7,4'-二葡萄糖苷及葛根素、葛根素-7-木糖苷。《中国药典》以葛根素为指标成分进行含量测定，要求含葛根素不得少于2.4%。